性寒有毒，外用不可大面积或长久涂敷，内服不可过量或久用，服后要及时漱口的药是
A. 轻粉
B. 藜芦
C. 砒石
D. 露蜂房
E. 炉甘石

正确答案：A。轻粉

解析：本题考查的是轻粉的使用注意。性寒有毒，外用不可大面积或长久涂敷，内服不可过量或久用，服后要及时漱口的药是轻粉（A对）。轻粉：【使用注意】本品有毒，外用不可大面积或长久涂敷；内服不可过量或久服，孕妇及肝肾功能不全者忌服；服后要及时漱口，以免口腔糜烂。藜芦（B错）：【使用注意】本品有毒，内服宜慎。孕妇及体弱者忌服。不宜与细辛、赤芍、白芍、人参、丹参、玄参、沙参、苦参同用。砒石（C错）：【使用注意】本品有大毒，故外用不宜过量或长时间大面积涂敷，疮疡腐肉已净者忌用，头面及疮疡见血者忌用。内服不能浸酒，不可超量或持续使用。孕妇忌用。露蜂房（D错）：【使用注意】本品有毒而无补虚之功，故气血虚弱者忌服。炉甘石（E错）：【用法用量】外用：适量，研末撒或调敷，水飞点眼。